PKC可被上述哪种物质激活
A. IRS 1
B. cGMP
C. IP₃
D. DG
E. 神经生长因子

正确答案：D。DG